突发右侧肢体无力1小时，头颅CT左基底节区高密度
A. 脑出血
B. 脑梗塞
C. 蛛网膜下腔出血
D. 短暂性脑缺血
E. 脑肿瘤

正确答案：A。脑出血

解析：突出右侧肢体无力1小时，头颅CT左基底节区高密度，诊断为基底节区脑出血（A对）。脑出血可有头痛、恶心、呕吐等表现，基底节区出血时可有偏瘫、偏身感觉障碍及偏盲等症状，头颅CT可见基底节区圆形或卵圆形均匀高密度灶。脑梗塞（B错）可有明显脑实质损害症状，如偏瘫、偏身感觉障碍及偏盲等，24小时后头颅CT可见低密度梗死灶。蛛网膜下腔出血（C错）可有剧烈头痛、恶心呕吐等颅高压表现，脑膜刺激征阳性，头颅CT可见脑沟脑池高密度出血征象（P194）。短暂性脑缺血（D错）是由于局部脑或视网膜缺血引起的短暂性神经功能缺损，症状多在2小时内消失，不留影像学及体征异常，且容易反复发作（P173）。脑肿瘤（E错）分为良性肿瘤和恶性肿瘤，良性肿瘤生长缓慢，局限在脑内，可引起颅内高压的症状，头颅CT多表现为低密度灶；恶性肿瘤生长迅速，可发生转移，也可引起颅内高压症状，威胁生命，头颅CT可表现为多密度灶。